距状沟两侧的皮质接受
A. 内侧膝状体的纤维
B. 外侧膝状体的纤维
C. 背侧丘脑腹前核群的纤维
D. 背侧丘脑腹后内侧核的纤维
E. 背侧丘脑腹后外侧核的纤维

正确答案：B。外侧膝状体的纤维

解析：距状沟两侧的皮质为视觉中枢所在位置，接受来自外侧膝状体的纤维（B对）。内侧膝状体的纤维（A错）投射至颞横回的听觉中枢，传导听觉。背侧丘脑腹前核群的纤维（C错）投射至中央前回的躯体运动中枢，调节躯体运动。背侧丘脑腹后内侧核（D错）、腹后外侧核的纤维（E错）投射至中央后回的躯体感觉中枢，传导躯体感觉。